硫尿嘧啶可抑制甲状腺激素的合成，可用于治疗甲状腺功能亢进，主要是其抑制下列哪种酶的活性
A. 过氧化酶
B. 脱碘酶
C. 磷酸化酶
D. 氨基化酶
E. 水解酶

正确答案：A。过氧化酶